患者平素性急易怒，时有胁胀，近日胁胀加重，伴食欲不振，食后腹胀，便溏，舌苔薄白，脉弦。其证候是
A. 脾气虚
B. 脾阳虚
C. 脾肾阳虚
D. 肝脾不调
E. 肝胃不和

正确答案：D。肝脾不调

解析：肝郁脾虚，又称肝脾不调，是肝失疏泄，脾失健运所表现的证候。平素性急易怒多因气郁化火，肝失柔顺之性所致；胁胀多因肝失疏泄，经气郁滞所致；食欲不振，食后腹胀，均多因肝气横逆犯脾，脾气虚弱，不能运化水谷所致；便溏多因气滞湿阻，肠鸣矢气所致；舌苔薄白，脉弦，均多因肝郁脾虚所致。故为肝脾不调（D对）。脾气虚的辨证要点以食少、腹胀、便溏与气虚症状共见为主要表现，非上述症状（A错）。脾阳虚的辨证要点以食少、腹胀腹痛、便溏与虚寒症状共见为主要表现，非上述症状（B错）。脾肾阳虚的辨证要点以久泻久痢、水肿、腰腹冷痛等与虚寒症状共见为主要表现，非上述症状（C错）。肝胃不和的辨证要点以脘胁胀痛、嗳气、吞酸、情绪抑郁等为主要表现（E错）。